对于意外穿髓的患牙，一般选用何种盖髓剂
A. 氢氧化钙
B. 磷酸锌水门汀
C. 氧化锌丁香油糊剂
D. 砷酸酸酐
E. 碘仿氧化锌

正确答案：A。氢氧化钙

解析：本题考查盖髓剂。氢氧化钙，有利于消除炎症减轻疼痛，氢氧化钙在形成牙本质桥的过程中还可作为一种诱导剂，激活成牙本质细碱性磷酸酶而促进硬组织的形成，此外，氢氧化钙还具有一定的抗菌作用（A对）。磷酸锌水门汀在粘固的过程中释放游离酸，刺激牙髓，不能作为盖髓剂（B对）。当牙髓充血的可复性牙髓炎可用氧化锌丁香油糊剂安抚，当已经穿髓，不能用于盖髓（C错）。碘仿氧化锌用于乳牙根尖周炎的治疗，不是盖髓剂（E错）。砷酸酸酐不是盖髓剂，为干扰选项（D错）。